男，26岁。在工厂被锅炉高温蒸汽烫伤双下肢和臀部，伤处红肿明显，有大小不一的水疱形成，内含淡黄的澄清液体，创面红润、潮湿。该病人的烧伤分度是
A. 深Ⅱ°
B. Ⅲ°
C. Ⅲ°以上
D. Ⅰ°
E. 浅Ⅱ°

正确答案：E。浅Ⅱ°

解析：伤有大小不一的水疱形成，内含淡黄的澄清液体，创面红润、潮湿，说明没有损伤真皮乳头层以下，毛细血管网仍在，故烧伤等级分度应是浅Ⅱ°（E对）。深Ⅱ°（A错）伤及真皮乳头层以下，但仍残留部分网状层，深浅不尽一致，也可有水疱，但去疱皮后，创面微湿，红白相间，痛觉较迟钝。Ⅲ°及Ⅲ°以上（BC错）可深达肌肉甚至骨骼、内脏器官等。创面蜡白或焦黄，甚至炭化。硬如皮革，干燥，无渗液，发凉，针刺和拔毛无痛觉。可见粗大栓塞的树枝状血管网（真皮下血管丛栓塞）。Ⅰ°（A错）仅伤及表皮浅层，生发层健在。表面红班状、干燥，烧灼感，没有水疱。